用药时需关注肺毒性的药物是
A. 柔红霉素
B. 长春新碱
C. 紫杉醇
D. 博来霉素
E. 环磷酰胺

正确答案：D。博来霉素

解析：本题考查药物的不良反应。博来霉素（D对）最严重的毒性就是肺毒性，可出现间质性肺炎和肺纤维化，对骨髓抑制和胃肠道反应均较轻。柔红霉素（A错）为蒽环类抗肿瘤药，有心脏毒性。长春新碱（B错）为抑制蛋白质合成与功能的药物，有骨髓功能抑制的不良反应。紫杉醇（C错）易发生超敏反应。环磷酰胺（E错）属于破坏DNA的烷化剂，有膀胱毒性。